以下哪种疾病不属于疾病监测的范围
A. 肺炭疽
B. 传染性非典型性肺炎
C. 人感染高致病性禽流感
D. 脊髓灰质炎
E. 感冒

正确答案：E。感冒

解析：疾病监测信息报告管理系统：主要对法定报告的39种传染病进行监测。甲类传染病和乙类传染病中的肺炭疽、传染性非典型肺炎、人感染高致病性禽流感和脊髓灰质炎患者、病原携带者或疑似患者，应于2小时内上报给当地的疾病预防控制中心，同时通过网络直报。其他的应在24小时内通过国家信息报告管理系统进行报告。掌握“流行病的诊断和筛检试验及疾病监测”知识点。